X线诊断Ⅰ期尘肺主要依据是
A. 肺门蛋壳样变化
B. 网织阴影增多
C. 类圆形阴影或不规则小阴影分布范围不少于两个肺区
D. 肺大块纤维性病变
E. 明确的肺纹理改变

正确答案：C。类圆形阴影或不规则小阴影分布范围不少于两个肺区

解析：本题考查尘肺一期的诊断。当症状有下列表现之一者可诊断为尘肺一期：①有总体密集度1级的小阴影，分布范围至少达到2个肺区（C对ABDE错）；②接触石棉粉尘，有总体密集度1级的小阴影，分布范围只有1个肺区，同时出现胸膜斑；③接触石棉粉尘，小阴影总体密集度为0，但至少有两个肺区小阴影密集度为0/1，同时出现胸膜斑。